关于医德评价，错误的是
A. 医德评价的主体有两种：他人和自己
B. 进行医德评价的标准依据每个人不同而不同
C. 医德评价是医德原则和规范转化为医务人员行为的中介和桥梁
D. 进行医德评价不能只看行为的客观效果
E. 医德评价的方式有社会舆论、内心信念和传统习俗

正确答案：B。进行医德评价的标准依据每个人不同而不同

解析：进行医德评价的标准依据每个人不同而相同。掌握“医学道德评价”知识点。